药品零售企业供应和调配毒性药品
A. 凭盖有医生所在医疗单位公章的正式处方，不超过三日极量
B. 凭供作证销售给个人，不超过两日极量
C. 凭医师处方，不超过三日极量
D. 凭医师处方可供应四日极量
E. 凭盖有医生所在医疗单位公章的正式处方，不超过两日极量

正确答案：E。凭盖有医生所在医疗单位公章的正式处方，不超过两日极量

解析：本题考查医疗用毒性药品经营管理。零售药店供应和调配毒性药品，凭盖有医生所在的医疗单位公章的正式处方。每次处方剂量不得超过二日极量（E对）。